对污染源的综合评价一般可采用的方法是
A. 等标污染负荷、排毒系数等
B. 超标率、超标倍数、检出率
C. 环境质量指数法
D. 检测污染物排放的相对含量方法
E. 大气质量指数法

正确答案：A。等标污染负荷、排毒系数等

解析：本题考查对污染源的综合评价的方法。对污染源综合评价一般可采用等标污染负荷、排毒系数等方法（A对BCDE错）。等标污染负荷是把i污染物的排放量稀释到其相应排放标准时所需的介质量，用以评价各污染源和各污染物的相对危害程度。排毒系数是表示某种污染物的排放量及其毒性对人群健康慢性危害程度的相对指标。